看不到
A. 前庭窗
B. 蜗窗
C. 鼓室上隐窝
D. 面神经管凸
E. 岬

正确答案：C。鼓室上隐窝

解析：内侧壁又称迷路壁，其中部有圆形的隆起，称岬（E对） , 由耳蜗第一圈的隆凸形成。岬的后上方有一卵圆形小孔，称前庭窗（A对）或卵圆窗，通向前庭。岬的后下方有一圆形小孔，称蜗窗（B对）或圆窗。前庭窗的后上方有一弓形隆起，称面神经管凸（D对），内藏面神经。鼓室上隐窝（E错，为本题正确答案）的外侧壁即鼓膜的上方骨部。